属于短效糖皮质激素类的药物是
A. 泼尼松龙
B. 氢化可的松
C. 地塞米松
D. 曲安西龙
E. 米托坦

正确答案：B。氢化可的松